男性，75岁，胃癌根治术后7天，剧烈咳嗽时，突然出现切口疼痛，并流出少量淡红色液体，病人最可能出现了
A. 切口内癌细胞种植
B. 切口感染
C. 切口裂开
D. 切口血肿
E. 切口脂肪液化

正确答案：C。切口裂开

解析：本例患者为老年男性，有行胃癌根治术的病史，术后7天因剧烈咳嗽而突然出现切口疼痛，并有少量淡红色液体流出，最可能出现切口裂开（C对）。切口内癌细胞种植（A错）临床上较少见，并且会出现原发肿瘤症状。切口感染（B错）临床表现为切口局部红、肿、热、疼痛和触痛，可有分泌物与发热。切口血肿（D错）临床表现为切口部位不适感，肿胀和边缘隆起、变色，血液有时经皮肤缝线外渗。切口脂肪液化（E错）临床表现为切口愈合不良，部分病人可有黄色渗出液。